义齿利用树脂基托将钢丝弯制卡环、人工牙等连接成整体的义齿类型是
A. 牙与黏膜混合支持式义齿
B. 胶连式义齿
C. 牙支持式义齿
D. 金属铸造支架式义齿
E. 黏膜支持式义齿

正确答案：B。胶连式义齿

解析：胶连式义齿：义齿主要由甲基丙烯酸树脂制作，利用树脂基托将钢丝弯制卡环、人工牙等连接成整体。掌握“局部义齿类型，肯氏分类及模型观测”知识点。